在一次原因不明的慢性病病因研究中，流行病学工作者从各种因素中逐一探索哪一种因素是可能的危险因素，这种研究为
A. 现况调查
B. 验证性病例对照研究
C. 双向性队列研究
D. 历史性队列研究
E. 探索性病例对照研究

正确答案：E。探索性病例对照研究

解析：本题考查病例对照研究的优点。病例对照研究可以同时研究多个暴露与某种疾病的联系，特别适合于探索性（E对ABCD错）病因研究。